开展精神障碍诊断、治疗活动，应当具备下列条件，并依照医疗机构的管理规定办理有关手续，不正确的是
A. 必须配齐各种科室的医师
B. 从事精神障碍诊断、治疗的专科医疗机构还应当配备从事心理治疗的人员
C. 有满足开展精神障碍诊断、治疗需要的设施和设备
D. 有完善的精神障碍诊断、治疗管理制度和质量监控制度
E. 有与从事的精神障碍诊断、治疗相适应的精神科执业医师、护士

正确答案：A。必须配齐各种科室的医师